IL-1的功能不包括
A. 促进T细胞的增殖
B. 激活单核-吞噬细胞
C. 大量IL-1进入血流能诱导急性期蛋白
D. 抑制NK细胞
E. 可作为内源性致热原

正确答案：D。抑制NK细胞